可检测细胞因子分子量的技术是
A. western bolt
B. 3H-dR掺入法
C. 蛋白质芯片法
D. ELISPOT
E. 免疫共沉淀

正确答案：C。蛋白质芯片法

解析：可检测细胞因子分子量的技术是蛋白质芯片法（C对），蛋白质芯片是将高度密集排列的蛋白质分子作为探针点阵固定在固相支持物上，当与待测蛋白样品反应时，可捕获样品中的靶蛋白，再经检测系统对靶蛋白进行定性和定量分析的一种技术。蛋白质芯片技术应用广泛，如蛋白质表达谱、蛋白质功能、蛋白质间的相互作用的研究等。Western blot（即蛋白质印迹）（A错）用于检测样品中特异性蛋白质的存在、细胞中特异蛋白质的半定量分析以及蛋白质分子的相互作用研究等。3H-TdR掺入法（B错）可以用于检测淋巴细胞增殖。ELISPOT（即酶联免疫斑点试验）（D错）用于测定分泌特异性抗体或细胞因子的单个细胞对特异性抗原的应答能力，及产生应答的细胞数量。免疫共沉淀（E错）是研究蛋白质相互作用的经典方法。